治疗经断复来湿热下注证，应首选
A. 安老汤
B. 知柏地黄丸
C. 易黄汤
D. 萆薜胜湿汤
E. 龙胆泻肝丸

正确答案：C。易黄汤

解析：安老汤功能健脾调肝，育阴止漏，用于治疗经断复来肝郁脾虚证（A错）。知柏地黄丸功能滋阴清热降火，用于经断复来肾阴虚证（B错）。经断复来湿热下注证是由于湿浊下注，热邪伤络，损伤冲任导致的经断复行，治宜清热利湿，凉血止血，方选易黄汤加味（C对）。萆薢渗湿汤功能清热解毒利湿，合桂枝茯苓丸可治疗经断复来湿毒瘀结证（D错）。龙胆泻肝汤功能清泻肝胆实火，清利肝胆湿热。可治疗肝经湿热下注证，但经断复来湿热下注证病机主要是脾气受损，运化失职，郁久化热致湿热内生（E错）。